制备微囊常用的成囊材料是
A. 明胶
B. 乙基纤维素
C. 磷脂
D. 聚乙二醇
E. β-环糊精

正确答案：A。明胶

解析：本题考查药物微囊化的材料。制备微囊常用的成囊材料是明胶（A对）。常用的囊材可分为天然的、半合成或合成的高分子材料三大类：（1）天然高分子囊材：明胶、阿拉伯胶、海藻酸盐、壳聚糖。（2）半合成高分子囊材：羧甲基纤维素盐、醋酸纤维素酞酸酯（CAP）、乙基纤维素（EC）、甲基纤维素（MC）、羟丙甲纤维素（HPMC）。（3）合成高分子囊材：聚碳酯、聚氨基酸、聚乳酸（PLA）、丙交酯乙交酯共聚物、聚乳酸-聚乙二醇嵌段共聚物等。乙基纤维素（B错）不同程度地溶于有机溶剂，适用于多种药物的微囊化，遇强酸易水解，故对强酸性药物不适宜，用作囊材时，可加入增塑剂改善其可塑性。磷脂（C错）是制备脂质体的膜材。聚乙二醇（D错）为长循环脂质体的修饰材料。β-环糊精（E错）为制备包合物的包合材料。